有关气道高反应性（AHR）的描述正确的是
A. AHR是哮喘发作的重要神经机制
B. 气道炎症是导致AHR的重要机制
C. AHR检测阳性者可诊断支气管哮喘
D. 肺泡巨噬细胞激活可降低AHR
E. AHR不受遗传因素的影响

正确答案：B。气道炎症是导致AHR的重要机制

解析：气道高反应性（AHR）是指气道对各种刺激因子如变应原、理化因素、运动、药物等呈现的高度敏感状态，表现为患者接触这些刺激因子时气道出现过强或过早的收缩反应，有症状的哮喘患者几乎都存在AHR。气道慢性炎症是导致AHR的最重要机制（B对），当气道受到变应原或其他刺激后，多种炎症细胞释放炎症介质和细胞因子，气道上皮损害、上皮下神经末梢裸露等，从而导致气道高反应性，因此AHR是哮喘的重要综合性机制，而不是神经机制（A错）。肺泡巨噬细胞激活可进一步诱发AHR（D错）。AHR常有家族倾向，受遗传因素的影响（E错）。出现AHR者并非都是哮喘（C错），如长期吸烟、接触臭氧、病毒性上呼吸道感染、慢性阻塞性肺疾病等也可出现AHR，但程度相对较轻，因此AHR检测阳性者不可以诊断为支气管哮喘。